阿司匹林的杂质是
A. 游离水杨酸
B. 对氨基苯甲酸
C. 酮体
D. 罂粟酸
E. 多环芳烃

正确答案：A。游离水杨酸

解析：本题考查阿司匹林的杂质检查。阿司匹林的杂质是游离水杨酸（A对）。阿司匹林在生产过程中因乙酰化不完全或在贮藏过程中水解产生游离水杨酸。水杨酸在空气中会被逐渐氧化成醌型有色物质（淡黄色、红棕色、深棕色等），使阿司匹林变色，故需检查。对氨基苯甲酸（B错）是盐酸普鲁卡因等药物的杂质；酮体（C错）是盐酸肾上腺素等药物的杂质；罂粟酸（D错）是盐酸吗啡等药物的杂质。